健康教育与健康促进的效应评价内容不包括
A. 促成因素
B. 倾向因素
C. 强化因素
D. 健康相关行为
E. 危险因素

正确答案：E。危险因素